舌肌单侧收缩使舌尖伸向对侧的一对舌外肌是
A. 上、下纵肌
B. 颏舌肌
C. 颏舌骨肌
D. 二腹肌
E. 舌横肌

正确答案：B。颏舌肌

解析：颏舌肌(B对)为舌外肌，单侧收缩时可使舌尖伸向对侧。